致突变试验的质量控制应通过
A. 盲法观察
B. 设立阳性对照
C. 设立阴性对照
D. 以上都是

正确答案：D。以上都是

解析：本题考查致突变试验的质量控制。致突变试验的质量控制应通过盲法观察；设立阳性对照和阴性对照（D对ABC错）；资料的统计学分析；试验结果的重现性。